阿司匹林引起凝血障碍的原因是
A. 直接刺激作用
B. 水杨酸中毒
C. 白三烯等脂氧酶代谢产物增多
D. 能抑制血小板聚集凝血酶原形成
E. 抑制胃黏膜PG合成

正确答案：D。能抑制血小板聚集凝血酶原形成

解析：阿司匹林小剂量能抑制血小板聚集，延长出血时间；大剂量（5g/d以上）或长期服用，还能抑制凝血酶原形成，延长凝血酶原时间，使出血和凝血时间延长，易引起自发性出血（D对）。